霍乱患者最早出现的病理生理改变是
A. 急性肾衰竭
B. 急性肾上腺皮质功能不全
C. 急性心功能不全
D. 脑功能障碍
E. 大量水分及电解质丢失

正确答案：E。大量水分及电解质丢失

解析：由于剧烈腹泻及呕吐为霍乱患者最早出现的症状，导致体内水和电解质大量丧失，故霍乱患者最早出现的病理生理改变是大量水分及电解质丢失（E对）。急性肾衰竭（A错）、急性肾上腺皮质功能不全（B错）、急性心功能不全（C错）、脑功能障碍（D错）均是由于水电解质严重紊乱导致的，均出现在大量水分及电解质丢失之后。